依据《药物临床试验质量管理规范》，在药物临床试验的过程中，受试者的权益、安全和健康
A. 应该服从于药物临床试验的需要
B. 必须与对科学和社会利益的考虑相一致
C. 必须高于对科学和社会利益的考虑
D. 必须等同于对科学和社会利益的考虑
E. 应该给予一定的保障

正确答案：C。必须高于对科学和社会利益的考虑

解析：本题考查药物临床试验。依据《药物临床试验质量管理规范》，在药物临床试验的过程中，受试者的权益、安全和健康必须高于对科学和社会利益的考虑（C对）。